在我国，目前慢性肾衰最常见的病因是
A. 高血压肾病
B. 糖尿病肾病
C. 遗传性肾病
D. 原发性肾小球肾炎
E. 慢性肾盂肾炎

正确答案：D。原发性肾小球肾炎

解析：在我国，目前慢性肾衰最常见的病因是原发性肾小球肾炎（D对）；在发达国家，糖尿病肾病（B错）、高血压肾病（高血压肾小动脉硬化）（A错）是主要病因。